咽旁间隙感染的特点，叙述不正确的是
A. 间隙内含有疏松结缔组织，血管丰富
B. 感染可通过筋膜间隙的平面扩散
C. 可因呼吸、胸内负压及重力的作用形成纵隔脓肿
D. 间隙位置表浅，间隙感染如处理不及时，可导致严重的肺部感染
E. 源于口底、咽喉和中耳等部位的感染可累及咽后、咽旁、下颌下等间隙

正确答案：D。间隙位置表浅，间隙感染如处理不及时，可导致严重的肺部感染

解析：咽旁间隙感染的特点：①间隙内含有疏松结缔组织，血管丰富，一旦感染，感染性坏死物质极易扩散和吸收，引起难以控制的致死性全身脓毒败血症。②源于口底、咽喉和中耳等部位的感染累及咽后、咽旁、下颌下间隙等颈深筋膜间隙时，感染可通过筋膜间隙的平面扩散，并因呼吸、胸内负压及重力的作用形成纵隔脓肿。③间隙位置深在，咽旁间隙感染如处理不及时，可导致严重的肺部感染、菌血症和颈内静脉血栓性静脉炎等并发症。掌握“颞间隙、咽旁间隙感染”知识点。